关于药品贮存要求的说法，正确的是
A. 常温（室温），指10℃～30℃
B. 阴凉处，指不超过25℃的环境中
C. 避光，指用不透光的容器包装
D. 遮光，指避免日光直射
E. 凉暗处，指在2℃～10℃的环境中且避光

正确答案：A。常温（室温），指10℃～30℃

解析：本题考查药品的贮存。常温（室温），指10℃～30℃（A对）。如标明“阴凉处”贮存，则应贮存在不超过20℃（B错）的环境中。如标明在“凉暗处”贮存，则贮存温度不超过20℃并避光保存（E错）。如标明在“冷处”贮存，则应贮存在2℃～10℃环境中。避光是避免日光直射（C错），遮光指用不透光的容器包装（D错）。